血府逐瘀汤的功用是
A. 活血祛瘀、行气止痛
B. 活血祛瘀、疏肝通络
C. 活血祛瘀、养血清热
D. 活血祛瘀、散结止痛
E. 活血祛瘀、温经止痛

正确答案：A。活血祛瘀、行气止痛

解析：血府逐瘀汤方含桃仁破血行滞而润燥，红花活血祛瘀以止痛。赤芍、川芎助君药活血祛瘀；牛膝入血分，性善下行，能祛瘀血，通血脉，并引瘀血下行，使血不郁于胸中，瘀热不上扰。生地黄甘寒，清热凉血，滋阴养血；合当归养血，使祛瘀不伤正；合赤芍清热凉血，以清瘀热。三者养血益阴，清热活血。桔梗、枳壳，一升一降，宽胸行气，桔梗并能载药上行；柴胡疏肝解郁，升达清阳，与桔梗、枳壳同用，尤善理气行滞，使气行则血行。甘草调和诸药，为使药。合而用之，共奏活血化瘀，行气止痛之功（A对）。